净水器卫生安全性评价浸泡水水质卫生指标包括
A. 感官性状指标、一般化学指标、毒理学指标和放射性指标
B. 感官性状指标、毒理学指标、微生物指标和放射性指标
C. 感官性状指标、一般化学指标、微生物指标和放射性指标
D. 感官性状指标、一般化学指标、毒理学指标和微生物指标
E. 一般化学指标、毒理学指标、微生物指标和放射性指标

正确答案：D。感官性状指标、一般化学指标、毒理学指标和微生物指标

解析：本题考查净水器卫生安全性评价浸泡水水质卫生指标。净水器卫生安全性评价浸泡水水质卫生指标包括感官性状指标、一般化学指标、毒理学指标和微生物指标（D对ABCE错）。